一般内脏运动核发出纤维支配
A. 舌肌，眼球外肌
B. 咽喉肌
C. 面肌
D. 平滑肌、心肌、腺体
E. 无

正确答案：D。平滑肌、心肌、腺体

解析：一般内脏运动核发出纤维支配平滑肌、心肌、腺体（D对）。